最易发生腺源性感染的间隙是
A. 颞下间隙感染
B. 眶下间隙感染
C. 翼下颌间隙感染
D. 咬肌间隙感染
E. 下颌下间隙感染

正确答案：E。下颌下间隙感染

解析：下颌下间隙感染多见于下颌智牙冠周炎、下颌后牙尖周炎、牙槽脓肿等牙源性炎症的扩散。其次为下颌下淋巴结炎的扩散。化脓性下颌下腺炎有时亦可继发下颌下间隙感染。掌握“下颌下间隙、颊间隙感染”知识点。